关于生态平衡的定义，下列正确的是
A. 生物与生物之间的动态
B. 生物与环境之间的暂时平衡
C. 生物与生物，生物与环境之间的暂时相对的平衡
D. 生物与环境之间的动态平衡
E. 生物与生物之间、生物与环境之间的长期平衡

正确答案：C。生物与生物，生物与环境之间的暂时相对的平衡

解析：本题考查生态平衡的定义。生态平衡生物与生物，生物与环境之间的暂时相对的平衡（C对ABDE错）。